呼吸酸中毒对机体的影响中哪一项例外
A. 肺性脑病
B. 持续性头痛
C. 心律失常
D. 低钾血症
E. 心肌收缩力减弱

正确答案：D。低钾血症

解析：发生呼吸酸中毒时CO2浓度过高可发生CO2麻醉引起肺性脑病（A对），由于CO2 直接舒张血管的作用，脑血流增加、颅内压增高，因此常引起持续性头痛（B对）；K+从细胞内向细胞外转移，以维持细胞内外电平衡，从而产生高钾血症（D错，为本题正确答案），继而导致心律失常（C对），由于H+影响Ca2+内流，酸中毒易导致心肌收缩力减弱（E对）。